主要化学成分为三萜皂苷的中药有
A. 甘草
B. 黄芪
C. 人参
D. 三七
E. 合欢皮

正确答案：A、B、C、D、E。甘草；黄芪；人参；三七；合欢皮

解析：本题考查的是含三萜皂苷类化合物的常用中药。主要化学成分为三萜皂苷的中药有甘草（A对）、黄芪（B对）、人参（C对）、三七（D对）与合欢皮（E对）。三萜皂苷由三萜皂苷元和糖组成，苷元为三萜类化合物，其基本骨架由6个异戊二烯单位组成。含三萜皂苷类化合物的常用中药人参、三七、甘草、黄芪、合欢皮、商陆、柴胡等。